肝功能不全的患者的选药原则是
A. 肝肠循环
B. 肾毒性小肝代谢的药物
C. 肝毒性小肾代谢的药物
D. 肝肾双通道排泄的药物
E. 首关消除的药物

正确答案：C。肝毒性小肾代谢的药物

解析：本题考查特殊人群用药。肝功能不全的患者的选药原则是肝毒性小肾代谢的药物（C对）。肝功能不全患者用药原则：1.明确诊断，合理选药。2.避免或减少使用对肝脏毒性大的药物。3.注意药物相互作用，特别应避免与肝毒性的药物合用。4.肝功能不全而肾功能正常的患者可选用对肝毒性小并且从肾脏排泄的药物。5.初始剂量宜小，必要时进行治疗药物监测，做到给药方案个体化。6.定期监测肝功能，及时调整治疗方案。